患者，女，26岁，2个月前因外伤致一上前牙脱落，今要求烤瓷修复。口腔检查：左上侧切牙缺失，间隙正常，牙槽嵴无明显吸收。左上中切牙牙冠1/2缺损，已露髓，探稍敏感，叩诊阴性，无松动。左上尖牙牙冠良好，叩诊阴性，无松动。余牙未见异常。最适合的治疗方案是
A. 桩冠局部义齿
B. 覆盖义齿
C. 桩核与双端固定桥
D. 根内固位体固定桥
E. 以上都不是

正确答案：C。桩核与双端固定桥

解析：本题考查固定义齿修复设计。患者左上侧切牙缺失，间隙正常，牙槽嵴无明显吸收。根据缺失牙数目、部位、基牙条件，应行以13为基牙的双端固定修复。此患者缺牙数目少，因此，最适合的治疗方案为桩核与双端固定修复（C对E错）。患牙左上中切牙牙冠1/2缺损，已露髓，为增加基牙固位力，可行桩核修复治疗，桩冠固定义齿（A错）咀嚼能力较固定义齿弱。根内固位体固定桥（D错）未说明固定设计类型。根内固位体多用于经过完善根管治疗的死髓牙，目前，因为烤瓷修复技术的发展，根内固位体一般与全冠固位体联合使用。覆盖义齿（B错）在无牙颌患者能明显提高咀嚼效率但咀嚼功能仍不如固定义齿，在条件允许的情况下仍先选择固定义齿修复。